对两名职业和教育水平均不同的老年人，均做智力测试，测试智商结果都为80，测试者在给出智商水平结果时，要考虑教育水平和生活环境的不同，给出不同的解释。这一判断体现的心理测试原则为：
A. 中立性原则
B. 保密性原则
C. 标准化原则
D. 客观性原则
E. 综合性原则

正确答案：D。客观性原则

解析：应用心理学测验的基本原则包括标准化原则、保密性原则、客观性原则（AE错）。客观性原则，是对结果做出评价时遵循的原则，也是对结果的解释要符合受试者的实际情况（D对）。例如，两名职业和教育水平均不同的老人，测试的智商结果都为80，但考虑到他们教育水平和生活环境的不同，最后给出不同的解释。标准化原则（C错）是指测量应采用公认的标准化的工具，施测方法要严格根据测验指导手册的规定执行。保密性原则（B错）是指关于测验的内容、答案及记分方法只有做此项工作的有关人员才能掌握，不允许随意扩散，更不允许在出版物上公开发表。